下列不属于狂证的临床表现是
A. 狂妄躁动、胡言乱语
B. 精神亢奋、狂躁刚暴
C. 喧扰不宁、毁物打骂
D. 动而多怒、登高而歌
E. 精神抑郁、语无伦次

正确答案：E。精神抑郁、语无伦次

解析：狂躁不安证的表现为狂妄躁动,呼笑怒骂,打人毁物,不避亲疏,甚或登高而歌,弃衣而走,妄行不休,力逾常人。多因暴怒化火,炼津为痰,痰火扰神所致,常见于狂病等。癫证表现为：神识痴呆，精神抑郁，语无伦次（E错，为本题正确答案）。